患者，女，22岁。半年来颈部右侧出现结块，逐步增大增多，不痛不热，皮色暗红，2〜3枚互相融合，1周前一处穿溃，脓出清稀。其诊断是
A. 颈痈
B. 有头疽
C. 瘰疬
D. 失荣
E. 肉瘿

正确答案：C。瘰疬

解析：颈痈为生于颈部两侧或耳后、项下、颏下的急性化脓性疾病，初起局部肿胀、灼热、疼痛，具有明显的风温外感症状。题中患者无风温外感症状（A错）。有头疽是发生于肌肤间的急性化脓性疾病，其特点是初起皮肤上即有粟粒样脓头，焮热红肿胀痛，迅速向深部及周围扩散，脓头相继增多，溃烂后状如莲蓬、蜂窝，范围常超过9~12cm，大者可在30cm以上，好发于项后、背部等皮肤厚韧之处，多见于中老年人及消渴患者，容易发生内陷，题中无脓头，发于颈部（B错）。瘰疬多见于儿童或青年，好发于颈部的一侧或两侧，初期推之能动，不热不痛，多无全身症状，中期结核增大，皮核黏连，可互相融合成块，推之不动，如皮色渐转暗红，按之微热及微有波动感者为内脓已成，后期自溃后，脓水清稀，题中患者符合瘰疬的诊断（C对）。失荣是发于颈部耳之前的岩肿，生长较快，质地坚硬，溃后疮面渗流血水，高低不平，且患者多面容憔悴，形体消瘦（D错）。肉瘿为结喉正中一侧或双侧有单个肿块，呈半圆形，表面光滑，可随吞咽动作上下移动，按之不痛，生长缓慢，一般无全身症状，题中患者有结块融合，1周即穿溃（E错）。